胃窦
A. 即幽门窦
B. 即幽门管
C. 位于幽门部右侧
D. 胃溃疡的好发部位
E. 幽门梗阻的发生部位

正确答案：E。幽门梗阻的发生部位

解析：胃窦为幽门部(C错)，由中间沟分为幽门窦(A错)和幽门管(B错)，胃溃疡好发于胃的幽门窦接近胃小弯处(D错)，胃窦即幽门部为幽门梗阻的发生部位(E对)。